引起DIC诱因包括
A. 单核－巨噬细胞系统功能障碍
B. 肝功能严重障碍
C. 妊娠
D. 微循环障碍
E. 以上都是

正确答案：E。以上都是

解析：单核－巨噬细胞系统功能障碍（A对）、肝功能严重障碍（B对）、妊娠（C对）和微循环障碍（D对，E为本题正确答案）均是影响 DIC 发生发展的因素，即引起DIC诱因。